患者，女，31岁。大便溏泻，纳谷不香，心悸失眠，首选的药物是
A. 山药
B. 磁石
C. 莲子
D. 芡实
E. 金樱子

正确答案：C。莲子

解析：莲子甘可补脾，涩能止泻，既可补益脾气，又能涩肠止泻。莲子性味甘平，入心、肾经，能养心益肾，交通心肾而宁心安神。故治疗此患者大便溏泻，纳谷不香，心悸失眠等症状的首选药物为莲子（C对）。山药的功效为益气养阴，补脾肺肾，涩精止带。治疗脾虚食少，大便溏泻，白带过多；肺虚喘咳；肾虚遗精，带下，尿频；虚热消渴（A错）。磁石的功效为镇惊安神，平肝潜阳，聪耳明目，纳气平喘。治疗心神不宁，惊悸，失眠；肝阳上亢，头晕目眩；视物昏花，耳鸣耳聋；肾虚气喘（B错）。芡实的功效为益肾固精，补脾止泻，除湿止带。治疗肾虚遗精滑精，遗尿尿频；脾虚久泻；白浊，带下（D错）。金樱子的功效为固精缩尿，固崩止带，涩肠止泻。治疗遗精滑精，遗尿尿频，崩漏带下；久泻，久痢（E错）。